女，42岁腰腿痛2个月查体：下腰椎旁压痛，左下肢直腿抬高试验阳性（50度），加强试验阳性，外踝及足背外侧皮肤感觉减弱，踝反射消失，考虑为腰椎间盘突出症。最可能突出的间隙是
A. L₄～L₅
B. L₅～S₁
C. L₂～L₃
D. L₁～L₂
E. L₃～L₄

正确答案：B。L₅～S₁

解析：腰椎间盘突出部位不同，受累神经不同，病人常出现相应的感觉、肌力及反射异常。患者踝反射消失，外踝及足背外侧皮肤感觉减弱，根据P755 腰神经根病变的神经定位图表，可知该患者受累神经根为S1，故腰椎间盘突出的间隙是L5～S1（B对）。L4～5（A错）对应L5神经受累，表现为小腿外侧和足背痛触觉减退，拇趾背伸肌力减弱。L2～3（C错）对应L3受累，表现为股骨内髁感觉减退，股四头肌肌力减弱，膝反射减弱或消失。L1～2（D错）对应L2受累，表现为大腿前中部感觉减退，髂腰肌肌力减弱。L3～4（E错）对应L4受累，表现为内踝感觉减退，足背伸肌肌力减弱。